男，35岁，已婚。因尿道口有脓性分泌物到医院就诊，被诊断为淋病。如果患者拒绝将病情如实告知其妻子，医师所面对的境况属于
A. 多重趋避冲突
B. 趋避冲突
C. 双趋冲突
D. 双重趋避冲突
E. 双避冲突

正确答案：E。双避冲突

解析：医生一方面不想让其妻子感染，另一方面又不想违背保密原则，属于双避冲突（E对）。双重趋避冲突（D错）亦称双重接近-避式冲突，人们常常会遇到多个目标，每个目标对自己都有利也都有弊，反复权衡拿不定主意所产生的冲突。双趋冲突（C错）也称接近-接近式冲突，两个目标具有相同的吸引力，引起同样强度的动机，但由于受条件等因素的限制，无法同时实现，二者必择其一，即所谓“鱼和熊掌不可兼得”。